为降低毒性，斑蝥宜选用的炮制方法是
A. 扣锅煅炭
B. 米炒
C. 麸炒
D. 炒黄
E. 炒炭

正确答案：B。米炒

解析：本题考查的是斑蝥的炮制方法与炮制作用。为降低毒性，斑蝥宜选用的炮制方法是米炒（B对）。斑蝥【炮制方法】处方用名有斑蝥、炒斑蝥、米炒斑蝥。①斑蝥：取原药材，除去杂质，或取原药材，除去头、足、翅及杂质。②米炒斑蝥：将米置热锅中，用中文火加热至冒烟，投入斑蝥拌炒，至米呈黄棕色，取出，筛去米，除去头、足、翅，摊开放凉。【炮制作用】斑蝥味辛，性热；有大毒。归肝、胃、肾经。具有破血消癥，攻毒蚀疮的功能。①生斑蝥多外用，毒性较大，以攻毒蚀疮为主。用于瘰疬瘘疮，痈疽肿痛，顽癣瘙痒。②米炒斑蝥毒性降低，其气味得到矫正，可内服。以通经、破癥散结为主。扣锅煅（A错），又称密闭煅、闷煅、暗煅。煅炭的主要目的：①改变药物性能，产生或增强止血作用，如血余炭等。②降低毒性，如干漆等。采用扣锅煅法炮制的中药有血余炭等。麸炒（C错）的目的：①增强疗效，如山药、白术、芡实等。②缓和药性，如苍术、枳实、薏苡仁等。③矫臭矫味，如僵蚕等。常用炒黄法（D错）炮制的中药有牛蒡子、芥子、王不留行、莱菔子、苍耳子、槐花等。炒炭（E错）的目的：经炒炭炮制后可使药物增强或产生止血、止泻作用。